女性，26岁。左颈及腋下有无痛性肿块，体检时发现在左侧颈部、锁骨上和腋窝等处有肿大的无痛性孤立的淋巴结。以下哪些发现最有助于提示此病为霍奇金淋巴瘤而不是非霍奇金淋巴瘤
A. 累及口咽或鼻咽部
B. 发病早期全身剧烈瘙痒
C. 硬膜外肿瘤压迫脊髓
D. 有自身免疫性溶血性贫血
E. 弥漫型组织细胞型淋巴瘤

正确答案：B。发病早期全身剧烈瘙痒